男孩，10岁。体重超过同性别、同身高儿童体重均值的30%。不正确的处理是
A. 增加运动
B. 控制饮食
C. 药物治疗
D. 心理辅导
E. 监测体重

正确答案：C。药物治疗

解析：患者男孩，10岁，体重超过同性别、同身高体重均值得30%（中度肥胖）（八版实用儿科学P595），该患儿初步诊断考虑小儿单纯性肥胖症。肥胖症的治疗需1.控制饮食（B对），建议低脂、低糖、高蛋白、高微量营养素、适量纤维素食谱；2.增加运动（A对）：适当的运动能促使脂肪分解、减少胰岛素分泌。3.药物治疗（C错，为本题正确答案）效果不很肯定，一般不主张用药。心理辅导（八版实用儿科学P596）（D对）主要是矫正不良的饮食习惯，改变静逸的生活方式，加强对肥胖危害的认识等。监测体重（E对）为重要体重监测措施。